关于腓浅神经的说法中,有何错误
A. 分布于足底外侧皮肤
B. 分布于小腿外侧皮肤
C. 分布于小腿外侧肌群
D. 沿小腿外侧肌群之间下降
E. 为腓总神经的分支

正确答案：A。分布于足底外侧皮肤

解析：腓浅神经为腓总神经的分支（E对），在腓骨长肌深面下行，继而续行于腓骨长、短肌与趾长伸肌之间（D对），沿途分布于腓骨长肌和腓骨短肌（C对）以及小腿外侧（B对）、足背和第2-5趾背的皮肤（A错，为本题正确选项）。